糖尿病患者碳水化合物供给量以占总能量的多少为宜
A. 30%～40%
B. 40%～50%
C. 50%～60%
D. 60%～70%
E. 70%～80%

正确答案：C。50%～60%